具有“喜润恶燥”特性的脏腑是
A. 大肠
B. 胃
C. 小肠
D. 三焦
E. 膀胱

正确答案：B。胃

解析：胃喜润恶燥。与脾喜燥而恶湿相对而言，胃有喜润而恶燥的生理特性（B对）。同时，还应注意，肺喜润恶燥。肺气通于秋，燥为秋令主气，内应于肺。病理上，燥邪最易耗伤肺津，导致咽干鼻燥，干咳少痰等症。治疗多以润肺为主。大肠、小肠、三焦、膀胱均无"喜润恶燥"特性（ACED错）。